引起牙周脓肿最常见的病原菌是
A. 甲型溶血性链球菌
B. 类白喉杆菌
C. 无芽胞厌氧菌
D. 绿脓杆菌
E. 白念珠菌（白假丝酵母菌）

正确答案：C。无芽胞厌氧菌

解析：口腔感染：无芽胞厌氧菌单一菌或混合感染，是坏死性溃疡性牙龈炎、牙周炎、坏疽性口腔炎等口腔感染的主要病因。掌握“无芽胞厌氧菌”知识点。